关于临终关怀，正确的是
A. 仍以延长病人生命的积极治疗为主
B. 临终关怀是提供全方位的照护
C. 临终关怀注重的是对临终病人的照护
D. 临终病人死亡，临终关怀即可结束
E. 临终病人已脱离社会，因此，他们没有社会需求

正确答案：B。临终关怀是提供全方位的照护

解析：本题考查临终关怀伦理。临终关怀主要是向临终患者及其家属提供的包括医疗、护理、心理和社会等各方位的照护（B对），使临终患者的症状得到控制，痛苦得到缓解，生命质量得到尊重。